下列头部症状，属实证的是
A. 头颅过大
B. 头颅过小
C. 囱填
D. 囟陷
E. 解颅

正确答案：C。囱填

解析：囱填多因热邪炽盛，或颅内水液停聚，或脑髓有病等实邪（C对）所致。但小儿在哭泣时囱门可暂时稍微突起，安静后即恢复正常，此为生理。先天不足，肾精亏损，水液停聚于脑会导致头颅增大（A错），颅缝开裂，颜面较小，智力低下。肾精不足，颅骨发育不良，导致头颅狭小（B错），头顶尖圆，颅缝早合，智力低下。囱陷即囱门凹陷，多因吐泻伤津，气血不足和先天肾精亏虚、脑髓失充所致，多属虚证（D错），但6个月以内的婴儿囱门微陷属正常。解颅即囱门迟闭，骨缝不合。这是先天肾精不足，或后天脾胃虚弱，发育不良的表现，多见于佝偻病患儿，常兼有“五迟”（立迟、行迟、发迟、齿迟、语迟）、“五软”（头项软、口软、手软、足软、肌肉软）等症状（E错）。